哪些感觉传导通路不是由3级神经元组成的
A. 躯干四肢皮肤的精细触觉
B. 非意识性本体觉
C. 头面部的痛温觉和触觉
D. 意识性本体感觉
E. 视觉

正确答案：B。非意识性本体觉

解析：非意识性本体感觉（B对）传导通路是由 2 级神经元组成，而躯干四肢皮肤的精细触觉（A错）、头面部的痛温觉和触觉（C错）、意识性本体感觉（D错）和视觉（E错）是由3级神经元。